妊娠7个月，乏力食欲不振，腹胀上腹部疼痛半个月。巩膜皮肤黄染进行性加深，肝界缩小，血胆红素200pmol/L，ALT80U/L，尿胆红素阴性，诊断应考虑
A. 急性重型肝炎
B. 亚急性重型肝炎
C. 胆汁淤积性黄疸
D. 急性黄疸型肝炎
E. 妊娠急性脂肪肝

正确答案：E。妊娠急性脂肪肝

解析：妊娠晚期，乏力食欲不振，腹胀上腹部疼痛半个月（妊娠期脂肪肝典型临床表现），查体：巩膜皮肤黄染进行性加重，肝界缩小，实验室检查：血胆红素200pmol/L（正常值为2-20pmol/L，胆红素明显升高），ALT80U/L（正常值为5-40U/L，转氨酶升高，肝功能受损），尿胆红素阴性，根据该患者的临床表现、体征及试验室检查考虑最可能额诊断为妊娠期急性脂肪肝（E对）。胆汁淤积性黄疸（C错）以皮肤瘙痒为主要表现，血清胆汁酸升高，但无明显消化道症状及凝血功能障碍。急性重型肝炎（A错）、亚急性重型肝炎（B错）、急性黄疸型肝炎（D错）都是病毒性肝炎的不同分期及分型，既往有肝炎病史，血清病毒标志物为阳性，转氨酶水平更高。